在辅助生殖技术应用中，医务人员应综合考虑各种因素，告知患者目前可供选择的治疗手段及利弊风险，此规定所体现的伦理原则是
A. 伦理监督原则
B. 社会公益原则
C. 知情同意原则
D. 有利于患者原则
E. 保密原则

正确答案：D。有利于患者原则

解析：我国辅助生殖技术应用伦理准则：1.有利于患者2.知情同意3.保护后代4.社会公益（B错）5.保守医密（E错）6.严防商业化7.伦理监督（A错）。在辅助生殖技术应用中，医务人员应综合考虑各种因素，告知患者目前可供选择的治疗手段及利弊风险，此规定所体现的伦理原则是有利于患者原则（D对）。有利于患者（D对）①综合考虑患者病理、生理、心理及社会因素，医务人员有义务告诉患者目前可供选择的治疗手段、利弊及其所承担的风险，在其充分知情的情况下，提出有医学指征的选择和最有利的治疗方案。②禁止以多胎和商业化供卵为目的的促排卵。③不育夫妇对实施人类辅助生殖技术过程中获得的配子、胚胎拥有其选择处理方式的权利，技术服务机构必须对此有详细的记录，并获得夫方、妇方或双方的书面知情同意。④患者的配子和胚胎在未征得其知情同意的情况下，不得进行任何处理，更不得进行买卖。知清同意（C错）①人类辅助生殖技术必须在夫妇双方自愿同意并签署书面知情同意书后方可实施。②对人类辅助生殖技术适应证的夫妇，医务人员须使其了解：实施该技术的必要性、实施程序、可能承受的风险以及为降低这些风险所采取的措施、该机构稳定的成功率、每周期大致的总费用及进口、国产药物选择等与患者作出合理选择相关的实质性信息。③接受人类辅助生殖技术的夫妇在任何时候都有权提出中止该技术的实施，并且不会影响对其今后的治疗。④医务人员必须告知接受人类辅助生殖技术的夫妇及其已出生的孩子随访的必要性。⑤医务人员有义务告知捐赠者对其进行健康检查的必要性，并获取书面知情同意书。